婴儿，4个月。前囟未闭，后囟已闭。其诊断是
A. 囟门早闭
B. 囟门晚闭
C. 闭合正常
D. 前囟晚闭
E. 后囟早闭

正确答案：C。闭合正常

解析：后囟门在出生后2~4个月内关闭，部分患儿出生时已闭均属正常。前囟门在出生后12~18个月关闭。本例后囟门闭合时间正常，而年龄尚未达到前囟门闭合时间，因此，尚属正常，标准答案为C。